铅影响血红素合成过程主要通过抑制
A. δ-氨基-γ-酮戊酸合成酶
B. δ-氨基-γ-酮戊酸脱水酶
C. 血红素合成酶
D. A+B+C
E. 琥珀酸脱氢酶

正确答案：D。A+B+C